关于强心苷对心电图的影响，错误的是
A. Q-T间期缩短
B. T波幅度增大
C. P-P间期延长
D. P-R间期延长
E. S-T段降低呈鱼钩状

正确答案：B。T波幅度增大

解析：治疗量的强心苷对心肌电生理的影响在心电图中有相应的具体体现，治疗量清新感可引起Q—T间期缩短（A对），反映心室肌兴奋过程缩短；p—R间期延长（D对），反映方式传导减慢；P一P间期延长（C对）反映窦性心率减慢；T波幅度变小或倒置（B错，为本题正确答案），反映各部分心肌动作电位时程缩短；S—T段降低（E对）呈鱼钩状，反映动作电位2相时程缩短。